关于卵巢分泌的激素，错误的是
A. 雌激素
B. 糖蛋白激素
C. 孕激素
D. 类固醇激素
E. 雄激素

正确答案：B。糖蛋白激素

解析：卵巢分泌的激素主要是雌激素（A对）和孕激素（C对），及少量雄激素（E对），均为甾体激素，甾体激素属类固醇激素（D对），不是糖蛋白激素（B错，为本题正确答案）。妇产科学常涉及到的激素中为糖蛋白激素的为hCG（人绒毛膜促性腺激素）、FSH、LH。